下列不属于楔状缺损特点的是
A. 缺损程度由浅到深，可出现不同的并发症
B. 楔状缺损不随年龄的增长而变化
C. 缺损边缘整齐，表面坚硬而光滑
D. 典型楔状缺损，由两个平面相交而成
E. 最早发生的是牙本质过敏症

正确答案：B。楔状缺损不随年龄的增长而变化

解析：楔状缺损临床表现：①典型楔状缺损，由两个平面相交而成，少数的缺损则呈卵圆形。缺损边缘整齐，表面坚硬而光滑，一般均为牙组织本色。②好发于上下颌尖牙、前磨牙和第一磨牙，尤其是第一前磨牙，位于牙弓弧度最突出处，一般有牙龈退缩。③缺损程度由浅到深，可出现不同的并发症。最早发生的是牙本质过敏症。随着缺损深度增加，可出现相应的牙髓疾病和根尖周疾病。缺损过多可导致牙冠折断。④随年龄增长，楔状缺损有增加的趋势，年龄愈大，楔状缺损愈严重。掌握“楔状缺损”知识点。